新生儿溶血病如需要换血疗法，经审核和患儿家属或监护人同意后，换血工作应由
A. 经治医师实施
B. 上级医师实施
C. 输血科人员实施
D. 经治医师和输血科人员共同实施
E. 上级医师和输血科人员共同实施

正确答案：D。经治医师和输血科人员共同实施

解析：《临床输血技术规范》第十一条：新生儿溶血病如需要换血疗法的，由经治医师申请，经主治医师核准，并经患儿家属或监护人签字同意，由经治医师和输血科人员共同实施（D对）。